下列不是“扳机点”在上颌支的部位的是
A. 眶下孔
B. 下眼睑
C. 鼻唇沟
D. 颞部
E. 鼻孔下方

正确答案：D。颞部

解析：本题考查三叉神经痛。颞部（D错，为本题正确答案）不是“扳机点”在上颌支的部位。“扳机点”在上颌支的部位：眶下孔（A对）、下眼睑（B对）、鼻唇沟（C对）、鼻翼、上唇、鼻孔下（E对）方或口角区、上颌结节或腭大孔等部位。